男，30岁，头部外伤6小时，伤后有一过性意识障碍，3小时后再次出现昏迷。检查左颞部头皮血肿，左瞳孔散大。CT扫描显示左侧颞叶硬膜外血肿。首选治疗方案
A. 应用止血药
B. 应用脱水药
C. 钻孔引流术
D. 应用皮质激素类药物
E. 甘露醇脱水准备开颅

正确答案：E。甘露醇脱水准备开颅

解析：对于急性硬膜外血肿合并脑疝的患者，应采用20%的甘露醇快速静滴以降低颅内压，同时准备行开颅手术（E对），清除血肿，妥善止血。应用止血药（A错）为一般性治疗措施。应用脱水药（B错）及钻孔引流术（C错）可暂时缓解颅内高压，但无法从根本上解除引起颅内压增高的原因，控制颅内出血。应用皮质激素类药物（D错）多用于防治继发性脑水肿。